目前用于临床的第一线抗结核病药，不包括
A. 异烟肼
B. 利福平
C. 乙胺丁醇
D. 链霉素
E. 对氨基水杨酸

正确答案：E。对氨基水杨酸

解析：目前用于临床的抗结核病药种类很多，通常把疗效高、不良反应较少，病人较易耐受的称为第一线抗结核病药，包括异烟肼、利福平，乙胺丁醇、链霉素、吡嗪酰胺等。掌握“异烟肼、利福平及乙胺丁醇”知识点。